对于在我国儿童龋齿的流行特点，你认为描述正确的一项是
A. 幼儿园儿童的龋患率高于小学生，小学生低于中学生
B. 幼儿园儿童的龋患率高于小学生，小学生高于中学生
C. 幼儿园儿童的龋患率低于小学生，小学生低于中学生
D. 城市高于农村，中小城市高于大城市
E. 农村高于城市，大城市高于中小城市

正确答案：B。幼儿园儿童的龋患率高于小学生，小学生高于中学生